可利用其草酸盐在水中的溶解度小进行分离的是
A. 麻黄碱
B. 番木鳖碱
C. 奎宁
D. 奎尼丁
E. 金鸡尼丁

正确答案：A。麻黄碱

解析：本题考查的是生物碱盐溶解度。可利用其草酸盐在水中的溶解度小进行分离的是麻黄碱（A对）。生物碱盐一般易溶于水，可溶于甲醇、乙醇，难溶或不溶于亲脂性有机溶剂。生物碱在酸水中成盐溶解，调碱性后又游离析出沉淀，可利用此性质提取分离生物碱。某些生物碱盐难溶于水，如小檗碱盐酸盐、麻黄碱草酸盐等。